子宫内膜的功能层由哪层再生
A. 基底层
B. 功能层
C. 子宫肌层
D. 海绵层
E. 致密层

正确答案：A。基底层

解析：子宫内膜分为基底层和功能层。基底层靠近子宫肌层，不受卵巢激素周期性变化的影响，月经期不脱落；功能层由基底层再生而来，受卵巢性激素的影响出现周期性变化，若未受孕功能层坏死脱落形成月经。掌握“女性生殖系统生理”知识点。